男，83岁，劳累时胸痛，慢性阻塞性肺疾病30年，慢性肾脏疾病20年，查体：R25次/分，血压100/70mmhg，双肺呼吸音减弱，可闻及湿啰音、哮鸣音，心率90次/分，律齐，主动脉听诊区可闻及收缩期粗糙杂音，心脏超声显示LVEF45%，主动脉瓣重度狭窄，冠状动脉造影显示右冠远端50%狭窄。下列治疗正确的是
A. 冠脉支架术
B. 开胸主动脉修补术
C. 冠脉搭桥术
D. 经皮主动脉瓣置换术
E. 心衰治疗

正确答案：D。经皮主动脉瓣置换术

解析：老年男性患者，劳累时胸痛，有慢阻肺、肾脏病史。查体：可闻及湿啰音哮鸣音（肺淤血表现），主动脉听诊区可闻及收缩期粗糙杂音（主动脉瓣狭窄典型表现），心脏超声显示LVEF45%，主动脉瓣重度狭窄（提示主动脉瓣狭窄），冠状动脉造影显示右冠远端50%狭窄（主动脉瓣狭窄引起的并发症），故诊断为主动脉瓣狭窄。凡出现临床症状者，均应考虑手术治疗。若不做主动脉瓣置换，3年死亡率可达75%。主动脉瓣置换后，存活率接近正常（D对）。当主动脉瓣狭窄解除之后，右冠远端50%狭窄自然而然就会逐渐恢复（AC错）。开胸对患者损伤大，不在必要情况下一般不行开胸治疗（B错）。患者有肺淤血体征（心衰表现），在等待手术的过程中，可慎用利尿剂以缓解肺淤血，但不是主要治疗（E错）。